某患者，右上中切牙牙冠3/4缺损，无叩痛，无松动，牙龈无红肿，X线示该牙已经过完善的根管治疗，根尖无阴影，最适合的治疗方案是
A. 嵌体
B. 3/4冠
C. 开面冠
D. 桩核+全冠
E. 全冠

正确答案：D。桩核+全冠

解析：本题考查桩核冠的适应证。桩核冠可增加牙体组织抗力和固位，防止剩余牙体组织过薄而发生冠折。因此最佳治疗方案应选择桩核+全冠修复（D对）。根据题干，患牙牙冠缺损3/4，剩余牙体组织较少，抗力不足，直接全冠修复（E错）易造成冠折，且全冠固位不良。嵌体修复（A错）无法形成足够抗力形和固位形，易脱落，3/4冠（B错）及开面冠（C错）固位力不及全冠修复，因为更不适合。